盒形洞的要求中下列哪项是不正确的
A. 洞底平
B. 洞侧壁直
C. 洞侧壁与洞底相垂直
D. 洞各侧壁与牙长轴平行
E. 点线角锐利

正确答案：E。点线角锐利

解析：本题考查窝洞的抗力形-盒状洞形。盒状洞形的点线角应圆钝，避免产生应力集中（E错，为本题的正确答案）。盒形洞要求洞底平（A对）、洞侧壁直（B对）以使咬合力均匀分布，避免应力集中。盒形洞洞侧壁与洞底相垂直（C对）、洞各侧壁与牙长轴平行（D对）避免充填体受力时移动而产生剪切力。